患者刘某，男性，34岁。水肿反复消长不已，面浮身肿，腰以下肿甚，按之凹陷不起，腰部冷痛酸重，尿量减少，四肢厥冷，怯寒神疲，面色灰滞，甚者心悸胸闷，喘促难卧，腹大胀满，舌质淡胖，苔白，脉沉细。其中医证型是
A. 脾阳虚衰证
B. 肾阳衰微证
C. 脾肾气虚证
D. 肝肾阴虚证
E. 瘀水互结证

正确答案：B。肾阳衰微证

解析：患者以水肿为主症，且水肿水肿反复消长不已，面浮身肿，腰以下肿甚，按之凹陷不起，故诊断为水肿阴水证。肾阳虚衰，蒸化无力，水液内停，脾虚水肿，久延不愈，伤及肾阳。腰膝以下，肾气主之，肾气虚衰，阳不化气，水湿下聚，故见腰以下肿甚，按之凹陷不起。水气上凌心肺，故见心悸胸闷，喘促难卧。腰为肾之府，肾虚而水气内盛，故腰部冷痛酸重。肾与膀胱相表里，肾阳不足，膀胱气化不行，故尿量减少。肾阳亏虚，命门火衰，不能温养，故四肢厥冷，怯寒神疲。阳气不能温煦上荣，则纳少、畏寒肢冷、面色灰滞。舌质胖淡，苔白，脉沉细或沉迟无力，均为阳气虚衰，水湿内盛之候，故患者为水肿阴水之肾阳衰微证（B对）。水肿之脾阳虚衰证症状：水肿日久，腰以下为甚，按之凹陷不易恢复，脘腹胀闷，纳呆便溏，面色萎黄，神疲乏力，四肢倦怠，小便短少，舌质淡，苔白腻或白滑，脉沉缓或沉弱（A错）。水肿无脾肾气虚证型（C错）。水肿无肝肾阴虚证型（D错）。水肿之瘀水互结证症状：水肿延久不退，肿势轻重不一，四肢或全身浮肿，以下肢为主，皮肤瘀斑，腰部刺痛，或伴血尿，舌质紫暗或有瘀斑，苔白，脉沉细涩（E错）。